对于龋病有意义的是菌斑的无氧酵解过程属于
A. 牙菌斑形成
B. 分解代谢
C. 硬组织脱矿
D. 合成代谢
E. 菌斑溶解

正确答案：B。分解代谢

解析：分解代谢属于对于龋病有意义的是菌斑的无氧酵解过程。掌握“龋病的临床表现与分类”知识点。